有关糖皮质激素的叙述正确的是
A. 小剂量抑制体液免疫，大剂量抑制细胞免疫
B. 可直接中和细菌内毒素和细菌外毒素
C. 抑制胃酸分泌，促进胃黏液分泌
D. 能兴奋中枢，出现欣快，激动等，甚至可诱发精神病
E. 能明显增加血液中性粒细胞数，增强其游走吞噬功能

正确答案：D。能兴奋中枢，出现欣快，激动等，甚至可诱发精神病